引起血管炎的主要因素是
A. 肥大细胞
B. 中性粒细胞
C. RBC
D. 嗜酸粒细胞
E. 嗜碱粒细胞

正确答案：B。中性粒细胞

解析：Ⅲ型超敏反应又称免疫复合物型或者血管炎型变态反应。是由抗原抗体结合形成中等大小的可溶性免疫复合物沉积于局部或全身多处毛细血管基底膜后，激活补体，并在各种效应细胞参与下引起的以充血水肿、局部坏死和中性粒细胞浸润为主要特征的炎症反应和组织损伤。掌握“概述及Ⅰ型超敏反应”知识点。